复杂部分性发作的病损在
A. 中央前回
B. 黑质-纹状体
C. 颞叶
D. 枕叶
E. 小脑

正确答案：C。颞叶

解析：癫痫复杂部分性发作病灶多在颞叶（C对），因而也叫颞叶癫痫。中央前回（A错）及附近是癫痫部分运动性发作病灶（P6）。黑质-纹状体（B错）是帕金森病病变部位（P277）。枕叶（D错）病损主要引起视觉障碍，枕叶癫痫主要表现为伴有视觉症状的单纯部分性发作（P8）。小脑（E错）病损主要表现为共济失调（P19）。